氯霉素
A. 首选用于治疗伤寒、副伤寒
B. 常用于其他药物疗效欠佳的脑膜炎患者
C. 可与氨基糖苷类抗生素合用，治疗厌氧菌心内膜炎、败血症
D. 用于衣原体、支原体等感染
E. 首选用于百日咳、菌痢等

正确答案：A、B、D。首选用于治疗伤寒、副伤寒；常用于其他药物疗效欠佳的脑膜炎患者；用于衣原体、支原体等感染